男，48岁，糖尿病12年，每日皮下注射胰岛素治，早餐前30单位，晚餐前24单位，每日进餐规律，主食量350g。近来查空腹血糖13.6～14.8mmol/L，餐后2小时血糖7.6～8.8mmol/L。关于空腹高血糖。较为合适的处理是
A. 调整进餐量
B. 改用口服降糖药
C. 加磺脲类降糖药物
D. 加双胍类降糖药物
E. 胰岛素调整剂量

正确答案：E。胰岛素调整剂量

解析：患者规律使用胰岛素替代治疗与饮食治疗后出现空腹高血糖，餐后血糖控制尚可，最可能的原因为夜间出现低血糖继发的反跳性高血糖或由于清晨升糖激素增多引起的高血糖即Somogyi效应或黎明现象。对于Somogyi效应可适度减少胰岛素剂量，对于黎明现象可适当增加胰岛素剂量，因此对于患者较为合适的处理为调整胰岛素剂量（E对）。减少晚餐进餐量（A错）、加磺脲类降糖药物（C错）、双胍类药物（D错）可使早晨空腹血糖降低但也会使夜间血糖降低，由于夜间血糖不明，不宜采取。口服降糖药疗效不如胰岛素，一般作为胰岛素治疗的辅助治疗，而不能替代胰岛素治疗（B错）。